洋地黄中毒时心脏毒性最常见的临床表现是
A. 心律失常
B. 胸痛
C. 黄视或绿视
D. 恶心
E. 咳粉红色泡沫痰

正确答案：A。心律失常

解析：洋地黄中毒时心脏毒性最常见的临床表现是各类心律失常（A对），包括室性期前收缩，非阵发性交界区心动过速，房性期前收缩心房颤动及房室传导阻滞等。洋地黄中毒无关一般无胸痛（B错）。黄视或绿视（C错）为洋地黄中毒的神经系统症。恶心（D错）为洋地黄中毒的胃肠道表现。咳粉红色泡沫痰（E错）是急性肺水肿的特异性表现，与洋地黄中毒无关。